香豆素类化合物在碱中长时间放置
A. 不发生变化
B. 生成顺式邻羟基桂皮酸盐
C. 生成顺式邻羟基桂皮酸
D. 生成反式邻羟基桂皮酸盐
E. 生成反式邻羟基桂皮酸

正确答案：D。生成反式邻羟基桂皮酸盐